男，68岁。恶心、上腹隐痛、呕吐少许咖啡样液体2天。高血压、血脂异常病史2年，长期口服阿司匹林100mg/d。胃镜检查可见胃窦粘膜多发糜烂，表面附着血性粘液。最适应的治疗药物是
A. 多潘立酮
B. 奥美拉唑
C. 枸橼酸铋钾
D. 硫糖铝
E. 法莫替丁

正确答案：B。奥美拉唑

解析：患者老年男性，恶心、上腹隐痛、呕吐少许咖啡样液体2天，服用阿司匹林（NSAIDs）病史，胃镜检查可见胃窦粘膜多发糜烂，表面附着血性粘液，结合上述病史、临床表现和实验室检查诊断为胃溃疡，该患者最适宜的治疗药物是奥美拉唑（B对）。多潘立酮（A错）促胃肠动力药物，不是治疗消化性溃疡的主要药物（P349）。枸橼酸铋钾（C错）是胃黏膜保护剂，与两种抗生素联用可以起到杀灭和抑制Hp的作用，但治疗消化性溃疡止痛效果较缓慢，不如奥美拉唑（P362）。硫糖铝（D错）属于弱碱性抗酸剂，不是治疗消化性溃疡的主要药物（P362）。法莫替丁（E错）是治疗消化性溃疡的主要药物之一，但疗效不如PPI（P361）。